患者，男，35岁。进食时左侧下颌下腺区肿胀、疼痛，停止进食数小时后，疼痛亦随之消退。检查见左侧导管口黏膜红肿，导管呈条索状，挤压腺体可见少许脓性分泌物自导管口溢出。根据上述症状，该患者最应做的检查是
A. 下颌下腺造影
B. 下颌骨侧位片
C. 曲面断层片
D. 下颌骨前后位片
E. 下颌横断（牙合）片

正确答案：E。下颌横断（牙合）片

解析：确诊应作X线检查，下颌下腺涎石投照下颌横断（牙合）片及下颌下腺侧位片，前者适用于下颌下腺导管较前部的涎石，后者适用于下颌下腺导管后部及腺体内的涎石。对于已确诊为涎石病者，不作唾液腺造影，以免将涎石推向导管后部或腺体内。掌握“涎石病及下颌下腺炎”知识点。